下列对于牙的描述，正确的是
A. 分为牙冠、牙颈、牙体、牙根四部分
B. 上颌磨牙有2个牙根
C. 下颌磨牙有3个牙根
D. 牙周组织由牙周膜、牙槽骨和牙龈构成
E. 牙组织由牙本质、釉质和牙骨质组成

正确答案：D。牙周组织由牙周膜、牙槽骨和牙龈构成

解析：牙分为牙冠牙颈和牙根三部分(A错)，上颌磨牙有3个牙根(B错)，下颌磨牙有2个牙根(C错)，牙周组织由牙周膜、牙槽骨和牙龈构成(D对)，牙组织由牙质、釉质、牙骨质和牙髓组成(E错)。